肠道细菌促进肠道黏膜免疫系统的早期发育，促进肠黏膜相关的淋巴组织中的
A. B细胞产生针对病原体的抗原
B. T细胞产生针对病原体的抗原
C. B细胞产生针对病原体的抗体
D. T细胞产生针对病原体的抗体
E. 以上说法均正确

正确答案：C。B细胞产生针对病原体的抗体

解析：与肠道菌群的关系：肠道菌群是定居在人消化道中菌群的集合。人肠道细菌的种类可达300～1000种。肠道细菌促进肠道黏膜免疫系统的早期发育，促进肠黏膜相关的淋巴组织中的B细胞产生针对病原体的抗体。掌握“黏膜免疫”知识点。